发现乙类传染病的肺炭疽、传染性非典型肺炎的患者，网络报告时限为
A. 1小时
B. 2小时
C. 6小时
D. 12小时
E. 24小时

正确答案：B。2小时

解析：本题考查传染病的报告时限。责任报告单位和责任疫情报告人发现乙类传染病中的肺炭疽、传染性非典型肺炎等按照甲类管理的传染病病人或疑似病人时，应于2小时（B对ACDE错）内将传染病报告卡通过网络报告。